麝香保心丸的功能是
A. 理气，宽胸，止痛
B. 行气活血，祛瘀止痛
C. 散瘀止血，消肿止痛
D. 芳香温通，益气强心
E. 益气和中，通络止痛

正确答案：D。芳香温通，益气强心

解析：本题考查的是麝香保心丸的功能。麝香保心丸的功能是芳香温通，益气强心（D对）。麝香保心丸：【功能】芳香温通，益气强心。冠心苏合滴丸：【功能】理气，宽胸，止痛（A错）。速效救心丸：【功能】行气活血，祛瘀止痛（B错）。增加冠脉血流量，缓解心绞痛。三七片：【功能】散瘀止血，消肿止痛（C错）。功能为益气和中，通络止痛（E错）的中成药，2022年考试指南未明确说明。